某些复合树脂充填后日久易变色，是由于其中成份含有
A. 甲基丙烯酸甲酯（稀释剂）
B. 芳香叔胺（促进剂）
C. 双酚A-甲基丙烯酸缩水油脂类
D. 2,6-二叔丁基对甲酚（阻聚剂）

正确答案：B。芳香叔胺（促进剂）

解析：本题考查复合树脂充填后日久易变色的原因。某些复合树脂充填后日久易变色，是由于其中成份含有芳香叔胺（促进剂）（B对），其能影响固化后材料的颜色稳定性，长时间后容易变黄。甲基丙烯酸甲酯（稀释剂）的增加（A错）使树脂强度降低。双酚A甲基丙烯酸缩水油脂类（C错）是复合树脂的基质成分，含量过多会降低树脂强度。2,6-二叔丁基对甲酚（阻聚剂）（D错）影响树脂聚合。